国家有关部门规定淘汰的放射诊疗设备不得购置、使用、转让和出租属于
A. 放射诊疗场所防护要求
B. 放射治疗的原则和实施
C. 对患者和受检者的防护要求
D. 放射诊疗工作人员防护要求
E. 放射诊疗设备和检测仪表的要求

正确答案：E。放射诊疗设备和检测仪表的要求

解析：不合格或国家有关部门规定淘汰的放射诊疗设备不得购置、使用、转让和出租。掌握“放射诊疗的防护与法律责任”知识点。